关于高压蒸汽灭菌法，不正确的描述是
A. 灭菌效果最可靠
B. 适用于耐高温和耐湿物品的灭菌
C. 可杀灭包括细菌芽胞在内的所有微生物
D. 通常灭菌压力为2.05kg/cm²
E. 通常灭菌温度为121.3℃

正确答案：D。通常灭菌压力为2.05kg/cm²